2-2缺失，种植修复方法是
A. 种植两颗固定修复
B. 种植三颗固定修复
C. 种植四颗固定修复
D. 种植一颗可摘修复
E. 种植两颗可摘修复

正确答案：A。种植两颗固定修复

解析：本题考查种植修复。2-2缺失，种植修复方法是种植两颗固定修复（A对）。固定式种植义齿为种植义齿上部结构与基台间采用粘接剂或通过螺丝连接固定的修复方式，患者不能自行取戴，外形近似天然牙，配戴舒适，固位及支持力强,咀嚼功能恢复佳。可分为单冠、联冠或固定桥三种方式修复。